男性老年人排尿困难，最常见于
A. 膀胱肿瘤
B. 尿道结石
C. 前列腺炎
D. 前列腺增生症
E. 尿路感染

正确答案：D。前列腺增生症

解析：前列腺增生多发于50岁以后的老年男性，而进行性排尿困难是前列腺增生最重要的症状（D对）。膀胱肿瘤以间断、全程、无痛性肉眼血尿为主要表现（A错）；尿道结石以小便不通或点滴而下，伴尿道刺痛为主要表现（B错）；前列腺炎以会阴、小腹坠胀，尿频、尿急、尿痛、排尿不适为主要表现（C错）；尿路感染以尿频、尿急、尿痛等膀胱刺激征为主要表现（E错）。